男，15岁。上感后2周出现肉眼血尿，BP150/95mmHg，临床诊断为急性肾小球肾炎。控制血压应首选
A. 血管紧张素转换酶抑制剂
B. 血管紧张素Ⅱ受体拮抗剂
C. 钙拮抗剂
D. ɑ受体阻断剂
E. 利尿剂

正确答案：E。利尿剂

解析：急性肾小球肾炎出现高血压一般是由钠水潴留引起，因此应首先使用利尿剂（E对）降低血压，在利尿剂控制血压不满意时再使用降压药物。ACEI（血管紧张素转化酶抑制剂）类药物（A错）、ARB（血管紧张素Ⅱ受体拮抗剂）类药物（B错）、钙拮抗剂（C错）、α受体阻断剂均可用于急性肾小球肾炎的降压治疗，但是应在利尿剂效果不理想之后再应用。